男，45岁。一年前发现血压170/110mmHg，长期口服氨氯地平等药物治疗，2个月前诊断为糖尿病，口服降糖药物治疗，目前血压、血糖均在正常范围。该患者高血压诊断正确的是
A. 高血压3级，高危
B. 高血压1级
C. 高血压2级，高危
D. 高血压3级，很高危
E. 高血压2级，很高危

正确答案：D。高血压3级，很高危

解析：患者中年男性，一年前发现血压170/110mmHg，由表3-5-1可知收缩压提示高血压2级，舒张压属于高血压3级，当舒张压和收缩压不在一个级别时原则为就高不就低，因此该患者为高血压3级（BCE错）。患者同时合并糖尿病，由表3-5-2可知患者的危险分层为很高危。综上所诉，该患者高血压诊断正确的是高血压3级，很高危（D对A错）。